效价高、效能强的激动剂是
A. 亲和力及内在活性都强
B. 具有一定亲和力但内在活性弱
C. 与亲和力和内在活性无关
D. 有亲和力、无内在活性，与受体不可逆性结合
E. 有亲和力、无内在活性，与激动剂竞争相同受体

正确答案：A。亲和力及内在活性都强

解析：本题考查作用于受体药物的分类。效价高、效能强的激动剂是亲和力及内在活性都强（A对）。激动药指既有较强的亲和力，又有较强的内在活性的药物。具有一定亲和力但内在活性弱（B错）的是部分激动药。与亲和力和内在活性无关（C错）的是非特异性药物。有亲和力、无内在活性，与受体不可逆性结合（D错）的是非竞争性拮抗剂。有亲和力、无内在活性，与激动剂竞争相同受体（E错）的是竞争性拮抗剂。